电话或信函调查，易发生
A. 入院率偏倚
B. 奈曼偏倚
C. 检出症候偏倚
D. 无应答偏倚
E. 回忆偏倚

正确答案：D。无应答偏倚